B细胞活化过程中的第一信号是
A. BCR识别Ag
B. IL-1的作用
C. 识别MHC分子
D. IL-2受体的产生
E. 黏附分子受体与配体的相互作用

正确答案：A。BCR识别Ag